痈好发于
A. 口腔及面部
B. 项部及背部
C. 四肢
D. 会阴部
E. 头皮

正确答案：B。项部及背部

解析：痈的病变是多个相邻毛囊及其周围组织同时发生急性细菌性化脓性炎症，常从毛囊底部开始向皮下组织蔓延，再向外周扩散，多个毛囊同时发生感染，病变范围较大，累计皮下及深层皮下组织，继而发生皮肤血运障碍直至坏死，多好发于皮肤较厚的部位，如项部和背部（B对）。